分隔左肝下前、后间隙的是
A. 肝圆韧带
B. 小网膜和胃
C. 冠状韧带
D. 镰状韧带
E. 肝肾韧带

正确答案：B。小网膜和胃

解析：左肝下前间隙位于肝左叶脏面腹膜与小网膜、胃前壁腹膜之间，左肝下后间隙为网膜囊，位于小网膜和胃(B对)后壁与腹后壁的腹膜之间，所以两者由小网膜和胃分隔。